产褥病率的定义是（产后每4小时测体温一次）
A. 分娩24小时后体温两次大于或等于38℃者
B. 产后24小时至10天内体温两次大于或等于38℃者
C. 产后1个月内体温两次大于或等于38℃者
D. 产后10天内体温两次大于或等于38℃者
E. 产褥期内体温两次大于或等于非孕期体温

正确答案：B。产后24小时至10天内体温两次大于或等于38℃者

解析：本题考查产褥病率的定义。产褥病率的定义是（产后每4小时测体温一次），产后24小时至10天内体温两次大于或等于38℃者（B对）。产褥感染指分娩及产褥期生殖道受病原体侵袭，引起局部或全身感染，其发病率约6%。产褥病率指分娩24小时以后的10日内，每日测量体温4次，间隔时间4小时，有2次体温达到或超过38℃。产褥病率常由产褥感染引起，但也可由生殖道以外感染如急性乳腺炎、上呼吸道感染、泌尿系统感染、血栓静脉炎等原因所致。